患者，男，62岁。胸闷刺痛，痛有定处，恶心呕吐，口中粘腻，头晕目眩，心悸气短，面部暗青，舌紫暗，苔白腻，脉弦滑。其治法是
A. 通阳泄浊
B. 豁痰理气
C. 祛瘀止痛
D. 益气养阴
E. 豁痰化瘀

正确答案：E。豁痰化瘀

解析：患者胸闷刺痛，痛有定处，为胸痹病，气郁日久，淤血内停，脉络不通，故见胸闷刺痛，痛有定处；痰浊困脾，脾气不运，故见恶心呕吐，口中粘腻；精气不能上承，故见头晕目眩，心悸气短，面部暗青；舌紫暗苔白腻，脉弦滑，均为痰瘀互结证，治疗需豁痰化瘀（E对），代表方为瓜蒌薤白半夏汤合桃红四物汤加减。通阳泄浊（A错）治疗治疗阳虚水泛证。豁痰理气（B错）治疗气滞痰阻证。祛瘀止痛（C错）用于治疗瘀血阻滞证。益气养阴（D错）用于治疗气阴两虚证。